患者，男，45岁。近日发现大便色黑，伴不规则上腹痛。检查：左锁骨上窝触及1个1cm1.2cm大小的淋巴结，质硬，大便隐血试验(+++)。应首先考虑的是
A. 消化性溃疡病
B. 胆道感染合并出血
C. 胃癌
D. 血小板减少性紫癜
E. 肝硬化

正确答案：C。胃癌